医院污水最常用的消毒方法是
A. 紫外线消毒
B. 臭氧消毒
C. 氯化消毒
D. 加热消毒
E. 超声波消毒

正确答案：C。氯化消毒

解析：本题考查医院污水最常用的消毒方法。医院污水消毒最常用的方法是氯化消毒（C对ABDE错），主要以次氯酸钠作为消毒剂。当消毒剂投加量及与污水接触时间充足时，通常可实现杀灭病原体的目标。采用含氯消毒剂消毒医疗机构污水时，若直接排入地表水体和海域，应先进行脱氯处理，使总余氯小于0.5mg/L。